片剂薄膜衣材料常选用
A. 羟丙基甲基纤维素
B. 丙烯酸树脂Ⅱ号和Ⅲ号混合液
C. 甘油明胶
D. 滑石粉
E. 胶浆

正确答案：A。羟丙基甲基纤维素

解析：本题考查片剂的薄膜衣材料。片剂薄膜衣材料常选用羟丙基甲基纤维素（A对）。胃溶型薄膜衣材料羟丙基甲基纤维素（HPMC）：是广泛应用的薄膜包衣材料。肠溶型薄膜衣材料：丙烯酸树脂类聚合物，丙烯酸树脂Ⅱ号、Ⅲ号混合（B错）使用。栓剂的水溶性基质：甘油明胶（C错），系用明胶、甘油与水以适当比例加热融合，滤过，放冷，凝固而成。制品有弹性，在体温下能软化并缓慢地溶于分泌液中，故作用缓和而持久。多用作阴道栓剂基质。糖衣的包衣材料有糖浆、滑石粉（D错）、胶浆（E错）、白蜡等。